关于硬脑膜，哪项描述是错误的
A. 由两层合成，外层兼具颅骨内骨膜的作用
B. 在脑神经出颅处移行为神经外膜
C. 形成大脑镰、小脑幕、硬脑膜窦等特殊结构
D. 硬脑膜窦是脑脊液产生的部位
E. 两层间有丰富的血管和神经

正确答案：D。硬脑膜窦是脑脊液产生的部位

解析：硬脑膜为厚而坚韧的双层膜，两层间有丰富的血管和神经（E对）。硬脑膜外层兼具颅骨内骨膜的作用（A对），内层折叠形成若干板状突起伸入各脑部之间保护脑部。硬脑膜在脑神经出颅处移行为神经外膜（B对）。由硬脑膜形成的结构包括大脑镰、小脑幕、小脑镰、硬脑膜窦等（C对）。脑脊液产生的部位主要是脑室脉络丛，而不是硬脑膜窦（D错，为本题正确答案）。